符合老年人营养需要的是
A. 总能量摄入量应增加
B. 摄入尽量多的动物蛋白质
C. 脂肪摄入不宜过多
D. 减少膳食纤维的摄入
E. 碳水化合物供能比低于50%

正确答案：C。脂肪摄入不宜过多

解析：本题考查老年人的营养需要。老年人的营养需要包括：1.能量：老年人对能量的需要降低，所以膳食能量的摄入主要以体重来衡量。老年人的体重应维持在正常稳定水平，不应过度苛求减重，体重过高或过低都会影响健康（A错）；2.蛋白质：老年人容易出现负氮平衡，且由于老年人肝脏和肾脏功能降低，摄入蛋白质过多可增加肝脏和肾脏的负担（B错）；3.脂肪：由于老年人胆汁分泌减少和酯酶活性降低而对脂肪的消化功能下降，因此，脂肪的摄入不宜过多（C对）；4.碳水化合物：老年人的糖耐量降低，血糖的调节作用减弱，容易发生血糖增高。过多的糖在体内还可转变为脂肪，引起肥胖、高脂血症等疾病。 建议碳水化合物提供的能量占总能量50%～65%为宜（E错）。而且，老年人应降低单糖、双糖和甜食的摄入量，增加膳食中膳食纤维的摄入（D错）。